用两种不同剂量的电离辐射照射小白鼠，第一种剂量照射25只，在照射后14天内死亡4只；第二种剂量照射18只，同时期内死亡5只。想知道这两种剂量对小白鼠致死作用是否相同，可选用的适当方法是
A. X²检验
B. 校正X²检验
C. μ检验
D. 直接计算概率法
E. 估算法

正确答案：A。X²检验

解析：本题考查X²检验。用两种不同剂量的电离辐射照射小白鼠，第一种剂量照射25只，在照射后14天内死亡4只；第二种剂量照射18只，同时期内死亡5只。想知道这两种剂量对小白鼠致死作用是否相同（分析分类变量数据即两种剂量对小白鼠致死作用是否相同的假设检验方法，推断两个或多个总体率或构成比之间有无差别），可选用的适当方法是X²检验（A对）。四格表的确切概率法不属于X²检验的范畴，但常作为四格表资料假设检验的补充（B错）。u检验是已知一个正态总体的方差б1，用给定的一组样本x₁、x₂…xn，检验总体均值μ2是否等于已知常数μ1的统计检验法（C错）。